根据《药品召回管理办法》，作出责令召回决定的是
A. 药品生产企业
B. 药品批发企业
C. 医疗机构
D. 药品零售企业
E. 药品监督管理部门

正确答案：E。药品监督管理部门

解析：本题考查的是药品召回分类。根据《药品召回管理办法》，作出责令召回决定的是药品监管部门（E对）。药品召回分类：（1）主动召回：是指药品生产企业（A错）对收集的信息进行分析，对可能存在安全隐患的药品进行调查评估，发现药品存在安全隐患的，由该药品生产企业决定召回。（2）责令召回：是指药品监管部门经过调查评估，认为存在安全隐患，药品生产企业应当召回药品而未主动召回的，责令药品生产企业召回药品。必要时，药品监督管理部门可以要求药品生产企业、经营企业（BD错）和使用单位（C错）立即停止销售和使用该药品。